密质骨的特点，描述错误的一项是
A. 密质骨表面为平行骨板
B. 密质骨在上颌牙槽骨的唇面很薄
C. 上颌骨比下颌骨密质骨厚而致密
D. 下颌的密质骨舌侧骨板比颊侧厚
E. 上颌舌侧密质骨较唇侧厚

正确答案：C。上颌骨比下颌骨密质骨厚而致密

解析：本题考查牙槽骨。密质骨是牙槽骨的外表部分，即颌骨内、外骨板延伸的部分。密质骨表面为平行骨板，深部有致密的不同厚度的哈弗系统的骨。密质骨在上颌牙槽骨的唇面，尤其前牙区密质骨很薄，有许多血管和神经穿过的滋养管，而舌侧增厚。在下颌骨则相反，密质骨比上颌厚而致密（C错，为本题正确答案），小孔很少，所以在施行局部麻醉时，在上颌前牙用局部浸润麻醉的效果比下颌好。通常下颌的密质骨，其舌侧骨板比颊侧厚，但在磨牙区由于担负较大的咀嚼力，磨牙颊侧骨板也增厚。